牙震荡主要表现为
A. 牙周膜损伤，牙齿硬组织及牙龈无损伤
B. 牙周膜及牙龈组织损伤，牙体硬组织无损伤
C. 牙龈组织及牙体硬组织损伤，牙周膜无损伤
D. 牙龈组织、牙周膜、牙体硬组织损伤
E. 牙周膜、牙体硬组织、牙槽骨损伤

正确答案：A。牙周膜损伤，牙齿硬组织及牙龈无损伤

解析：牙外伤时，牙周膜的轻度损伤称为牙震荡，可由较轻外力，如在进食时骤然咀嚼硬物所致。一般牙冠完整，通常不伴牙体组织的缺损。掌握“牙震荡”知识点。